以下不是防腐剂的是
A. 苯甲酸
B. 山梨酸
C. 双乙酸钠
D. 没食子酸丙酯
E. 丙酸钙

正确答案：D。没食子酸丙酯